腹部钝性损伤，腹壁未破裂却导致腹内下列某一脏器破裂时，出现腹膜炎症状最晚的是
A. 空肠
B. 回肠
C. 结肠
D. 十二指肠
E. 胃

正确答案：C。结肠

解析：结肠的主要功能是吸收水分和无机盐，不分泌消化液。腹部闭合性损伤致结肠破裂时，由于结肠内容物液体成分少而细菌含量多，故腹膜炎出现得较晚（C对），但较严重。空肠（A错）、回肠（B错）、十二指肠始、末两端（D错）和胃（E错）均为腹膜内位器官（表面几乎完全被腹膜覆盖的器官），而且可以分泌大量的消化液，一旦破裂后，消化液流入腹腔内可刺激腹膜，早期即可出现明显的腹膜刺激症状。